除另有规定外，应检查甲醇量的制剂有
A. 急支糖浆
B. 川贝雪梨膏
C. 国公酒
D. 双黄连口服液
E. 藿香正气水

正确答案：C、E。国公酒；藿香正气水

解析：本题考查的是酒剂与酊剂的质量要求。除另有规定外，应检查甲醇量的制剂有国公酒（C对）和藿香正气水（E对）。国公酒属于酒剂，酒剂系指中药饮片用蒸馏酒提取制成的澄清液体制剂。酒剂多供内服，也可外用。按照《中国药典》规定的方法检查，酒剂的总固体、乙醇量、甲醇量、装量及微生物限度等均应符合有关规定。藿香正气水属于酊剂，酊剂系指原料药物用规定浓度的乙醇提取或溶解而制成的澄清液体制剂，也可用流浸膏稀释制成。按照《中国药典》规定的方法检查，酊剂的甲醇量、乙醇量、装量及微生物限度等均应符合有关规定。急支糖浆（A错）属于糖浆剂，糖浆剂系指含有原料药物的浓蔗糖水溶液。按照《中国药典》规定的方法检查，糖浆剂的pH、相对密度、装量及微生物限度等均应符合规定。川贝雪梨膏（B错）属于煎膏剂，煎膏剂系指中药饮片用水煎煮，煎液浓缩，加炼蜜或炼糖（或转化糖）制成的半流体制剂，俗称膏滋。按照《中国药典》规定的方法检查，煎膏剂的相对密度，不溶物、装量及微生物限度均应符合规定。双黄连口服液（D错）属于合剂，合剂系指中药饮片用水或其他溶剂，采用适宜的方法提取、制成的口服液体制剂，其中单剂量灌装者也可称为口服液。合剂可以根据需要加入适宜的附加剂。在制剂确定处方时，该处方的抑菌效力应符合《中国药典》抑菌效力检查法的规定，山梨酸和苯甲酸的用量不得超过0.3%（其钾盐、钠盐的用量分别按酸计），羟苯酯类的用量不得超过0.05%，如加入其他附加剂，其品种与用量应符合国家标准的有关规定，不影响成品的稳定性，并应避免对检验产生干扰。必要时可加入适量的乙醇。